左心衰竭时，最早出现和最重要的症状是
A. 咳嗽
B. 咳痰
C. 咯血
D. 乏力
E. 呼吸困难

正确答案：E。呼吸困难

解析：左心衰以肺淤血及心排出量降低表现为主，其中呼吸呼吸困难是左心衰竭最早出现和最重要的症状（E对），咳嗽（A错）、咳痰（B错）、咯血（C错）、乏力（D错）同时也是左心衰竭的症状，但不是最早出现和最重要的症状。